餐后1～2小时、睡前或胃部不适时服用的抗酸剂是
A. 枸橼酸铋钾
B. 米索前列醇
C. 兰索拉唑
D. 铝碳酸镁
E. 泮托拉唑

正确答案：D。铝碳酸镁

解析：本题考查铝碳酸镁。铝碳酸镁（D对）为抗酸剂，餐后1～2小时、睡前或胃部不适时服用。枸橼酸铋钾（A错）为胃黏膜保护药，口服方式为一日2次，早晚各服0.6g，疗程4周。米索前列醇（B错）为终止早孕药，口服方式为一日0.8mg，分2或4次服用（早餐、中餐、晚餐时及睡前）。兰索拉唑（C错）为质子泵抑制药，服药方式为每日一次，一次二片（30mg）。泮托拉唑（E错）为消化系统用药，服药方式为每日早晨餐前40mg（1粒）。